剂量应当使用法定剂量单位，处方中溶液剂以
A. 升、毫升为单位
B. 克、毫克、微克为单位
C. 以支、瓶为单位
D. 支、盒为单位
E. 剂或付为单位

正确答案：C。以支、瓶为单位

解析：剂量应当使用法定剂量单位：溶液剂以支、瓶为单位。掌握“处方的开具、监督管理及法律责任”知识点。